除另有规定外，应避光，密封，置阴凉处贮存的是
A. 乳膏剂
B. 酊剂
C. 软膏剂
D. 合剂
E. 膏药

正确答案：B。酊剂

解析：本题考查的是酊剂的贮存方式。除另有规定外，应避光，密封，置阴凉处贮存的是酊剂（B对）。酊剂：系指原料药物用规定浓度的乙醇提取或溶解而制成的澄清液体制剂，也可用流浸膏稀释制成。除另有规定外，酊剂应遮光，密封，置阴凉处贮存。乳膏剂（A错）：系指原料药物溶解或分散于乳状液型基质中形成的均匀半固体制剂。乳膏剂应避光密封置25℃以下贮存，不得冷冻。软膏剂（C错）：系指原料药物与油脂性或水溶性基质混合制成的均匀的半固体外用制剂。除另有规定外，软膏剂应避光密封贮存。合剂（D错）：系指中药饮片用水或其他溶剂，采用适宜的方法提取、制成的口服液体制剂。除另有规定外，合剂应密封，置阴凉处贮存。膏药（E错）：系指饮片、食用植物油与红丹（铅丹）或官粉（铅粉）炼制成膏料，摊涂于裱褙材料上制成的供皮肤贴敷的外用制剂。除另有规定外，膏药应密闭，置阴凉处贮存。